反映某事物现象实际发生严重程度的指标宜采用
A. 年龄发病构成比
B. 年龄别发病率
C. 性别发病比
D. 发展速度环比
E. 标化率

正确答案：B。年龄别发病率